暴露组发病率与非暴露组发病率之差为
A. 相对危险度
B. 归因危险度
C. 归因危险度百分比
D. 发病密度
E. 人群归因危险度百分比

正确答案：B。归因危险度

解析：本题考查归因危险度。归因危险度（B对ACDE错）是暴露组发病率与非暴露组发病率相差的绝对值，表示危险特异地归因于暴露因素的程度。